蛋黄中具有降低胆固醇作用的是
A. 神经鞘磷脂
B. 脑磷脂
C. 卵磷脂
D. 脑苷脂
E. 谷固醇

正确答案：C。卵磷脂

解析：本题考查蛋黄中具有降低胆固醇作用的脂肪。卵磷脂（C对ABDE错）具有降低血胆固醇的作用，并能促进脂溶性维生素的吸收。